发生传染病流行时，县级以上地方政府有权在本行政区域内
A. 调集各级各类医疗、防疫人员参加疫情控制工作
B. 停工、停业、停课
C. 封锁甲类或按甲类传染病管理的传染病疫区
D. 封锁跨省、直辖市的疫区
E. 宣布疫区

正确答案：A。调集各级各类医疗、防疫人员参加疫情控制工作